注射剂处方中，伯洛沙姆188的作用是
A. 渗透压调节剂
B. 增溶剂
C. 抑菌剂
D. 抗氧剂
E. 止痛剂

正确答案：B。增溶剂

解析：本题考查注射剂常用的附加剂。伯洛沙姆188常用作注射剂中的增溶剂（B对）、润湿剂或乳化剂。其他常用的还有聚山梨酯80、聚维酮等。注射剂中常用的渗透压调节剂（A错）有氯化钠、葡萄糖、甘油等。注射剂中常用的抑菌剂（C错）有硫柳汞、三氯叔丁醇、苯甲醇等。注射剂中常用的抗氧剂（D错）有焦亚硫酸钠、亚硫酸钠、硫代硫酸钠等。注射剂中常用的止痛剂（E错）有盐酸普鲁卡因、利多卡因等。